用左旋多巴或受体阻断剂治疗震颤麻痹，哪项的治疗效果不明显
A. 肌肉强直
B. 随意运动减少
C. 动作缓慢
D. 面部表情呆板
E. 静止性震颤

正确答案：E。静止性震颤